对于窝沟浅龋，是由窝沟封闭技术衍生而来的预防方法是
A. 非创伤性修复术
B. 预防性树脂充填
C. “三明治技术”
D. 银汞充填术
E. 根管治疗术

正确答案：B。预防性树脂充填

解析：预防性树脂充填术是窝沟龋的有效防止方法。预防性树脂充填术是窝沟封闭技术衍生而成的，该治疗技术采用窝沟封闭剂。掌握“龋病的治疗原则与非手术治疗方法”知识点。